组成膜迷路的结构有
A. 椭圆襄、球囊、膜半规管和蜗管
B. 椭圆壺、球囊、壶腹崎和蜗管
C. 椭圆囊、壶腹峭、膜半规管和螺旋器
D. 椭圆囊、膜壶腹、蜗管和螺旋器
E. 无

正确答案：A。椭圆襄、球囊、膜半规管和蜗管

解析：椭圆囊和球襄、膜半规管和蜗管3部分组成膜迷路（A对BCD错）。